野菊花除清热解毒外，又能
A. 疏风平肝
B. 通利关节
C. 燥湿止带
D. 解暑，截疟
E. 明目，止痉

正确答案：A。疏风平肝

解析：本题考查的是野菊花的功效。野菊花除清热解毒外，又能疏风平肝（A对）。野菊花：【功效】清热解毒，疏风平肝。土茯苓：【功效】解毒，利湿，通利关节（B错）。秦皮：【功效】清热解毒，燥湿止带（C错），清肝明目。青蒿：【功效】退虚热，凉血，解暑，截疟（D错）。蝉蜕：【功效】疏散风热，透疹止痒，明目退翳，息风止痉（E错）。